有关叶酸的叙述正确的是
A. 动物与人体都能合成
B. 能直接转移一碳单位
C. 与核酸、蛋白质生物合成无关
D. 缺乏时影响红细胞成熟，能引起巨幼红细胞性贫血
E. 绿叶植物中含量不高

正确答案：D。缺乏时影响红细胞成熟，能引起巨幼红细胞性贫血

解析：叶酸缺乏时，DNA合成受到抑制，可造成巨幼细胞贫血。掌握“水溶性维生素”知识点。